能治涌吐痰饮的药是
A. 硼砂
B. 铅丹
C. 常山
D. 香薷
E. 儿茶

正确答案：C。常山

解析：本题考查的是常山的功效。能治涌吐痰饮的药是常山（C对）。常山：【功效】涌吐痰饮，截疟。硼砂（A错）：【功效】外用清热解毒，内服清肺化痰。铅丹（B错）：【功效】外用拔毒止痒，敛疮生肌；内服坠痰镇惊，攻毒截疟。香薷（D错）：【功效】发汗解表，和中化湿，利水消肿。儿茶（E错）：【功效】收湿敛疮，生肌止血，活血止痛，清肺化痰。